碘酊用于口腔内消毒剂的浓度是
A. 0.01
B. 0.015
C. 0.02
D. 0.005
E. 0.025

正确答案：A。0.01

解析：本题考查碘酊消毒。碘酊用于口腔内消毒剂的浓度是1%（A对）。碘酊一般浓度为2.0%,是常用的皮肤消毒剂。碘酊中的碘可直接卤化菌体蛋白质而产生杀菌作用，其杀菌作用强而快。但碘酊对皮肤黏膜的刺激性大，黏膜比较脆弱，容易灼伤黏膜，使用后皮肤发疱和脱皮，涂在破损伤口上疼痛较剧烈，故用在口腔内消毒时应使用的浓度必须降低。2.0%、2.5%、1.5%（BE错）浓度太高，故口腔内消毒使用的碘酊浓度为1%，而颌面部为2.0%（C错），头皮部为3%。而0.5%（D错）碘酊浓度太低，不能起到消毒的效果。